由于颞上回损伤所致，患者可以讲话及书写，也能看懂文字，但听不懂别人的谈话属于
A. 运动失语症
B. 失写症
C. 感觉失语症
D. 失读症
E. 以上均不是

正确答案：C。感觉失语症